五郁为病，先起于肝气郁结，在服汤药的同时，可常服用
A. 越鞠丸
B. 逍遥散
C. 龙胆泻肝汤
D. 丹栀逍遥散
E. 左金丸

正确答案：A。越鞠丸

解析：郁证的病因总属情志所伤，使肝气郁结，心气不舒，从而引起五脏气机不和所致。五郁为病，先起于肝气郁结，在服汤药的同时，可常服越鞠丸（A对）以行气解郁，因气行则血行，气畅则痰、火、湿、食诸自解。逍遥散可以理气解郁，调和肝脾（B错）。龙胆泻肝汤（C错）可以清泻肝胆实火和清利肝经湿热，用于治疗肝胆实火上炎证和肝经湿热下注证。丹栀逍遥散（D错）可以疏肝解郁，清肝泻火，用于治疗气郁化火证。左金丸主治肝郁化火和肝气犯胃（E错）。